冠心病稳定型心绞痛合并高血压首选
A. 钙离子拮抗剂
B. 利尿剂
C. β受体阻滞剂
D. 血管紧张素转换酶抑制剂
E. 血管紧张素Ⅱ受体阻滞剂

正确答案：C。β受体阻滞剂

解析：β受体阻滞剂和钙离子拮抗剂都可用于冠心病稳定型心绞痛的治疗。八版内科学P234指出钙离子拮抗剂更适合于稳定型心绞痛同时伴有高血压的患者。八版内科学P265指出β受体阻滞剂适用于高血压合并心绞痛患者。故两者应都可用于冠心病稳定型心绞痛合并高血压。但β受体阻滞剂（C对）可调节β受体密度平衡，防止儿茶酚胺对心脏的损害，改善心室和血管的重构及功能，长期应用对心绞痛的预防和治疗有积极作用，故应为冠心病稳定型心绞痛合并高血压首选用药。钙离子拮抗剂（A错）可抑制心肌收缩，减少心肌耗氧；扩张周围血管，降低动脉压，同时扩张冠脉，解除冠脉痉挛，故可作为变异型心绞痛合并高血压患者的首选用药。利尿剂（B错）适用于高血压合并肥胖或糖尿病、合并心力衰竭的患者的治疗。血管紧张素Ⅱ受体阻滞剂（E错）可以使冠心病患者的心血管死亡、非致死性心肌梗死等主要终点事件的相对危险性显著降低，稳定型心绞痛合并高血压建议使用，但两者在改善心肌缺血和减轻心绞痛症状的效果不如β受体阻滞剂。